关于网膜囊的叙述正确的是
A. 位于小网膜和胃后壁与腹后壁的腹膜之间
B. 位于大网膜的前、后层之间
C. 是一不规则的密闭间隙
D. 前壁是胃前壁的腹膜
E. 无

正确答案：A。位于小网膜和胃后壁与腹后壁的腹膜之间

解析：网膜囊位于小网膜和胃后壁与腹后壁的腹膜之间（A对B错），借肝十二指肠韧带后方的网膜孔与腹膜腔相交通，不是一个密闭间隙（C错），前壁为小网膜、胃后壁的腹膜和胃结肠韧带（D错）。